经长期临床应用证明安全、有效，对细菌耐药性影响较大，或者价格相对较高的抗菌药物是
A. 一级使用级
B. 备用使用级
C. 特殊使用级
D. 限制使用级
E. 非限制使用级抗菌药物临床应用管理分级

正确答案：D。限制使用级

解析：限制使用级抗菌药物是指经长期临床应用证明安全、有效，对细菌耐药性影响较大，或者价格相对较高的抗菌药物。掌握“抗菌药物临床应用概述及管理”知识点。